原发性肠套叠绝大部分发生于
A. 婴幼儿
B. 老年
C. 儿童
D. 青年
E. 中年

正确答案：A。婴幼儿

解析：可能由于食物性质的改变导致肠蠕动节律的紊乱，婴幼儿易发生原发性肠套叠（A对）。继发性肠套叠多见于成年人（BDE错），肠腔内或肠壁部器质性病变使肠蠕动节律失调，近段肠管的强力蠕动将病变连同肠管同时送入远段肠管中。